氯丙嗪引起的低血压状态应选用
A. 多巴胺
B. 肾上腺素
C. 麻黄碱
D. 异丙肾上腺素
E. 去甲肾上腺素

正确答案：E。去甲肾上腺素